干扰素α属于
A. I型干扰素
B. Ⅱ型干扰素
C. Ⅲ型干扰素
D. Ⅳ型干扰素
E. Ⅴ型干扰素

正确答案：A。I型干扰素